在复合树脂充填术中，整块充填适用于深度为
A. 小于4mm的窝洞
B. 小于5mm的窝洞
C. 小于6mm的窝洞
D. 小于7mm的窝洞
E. 小于8mm的窝洞

正确答案：A。小于4mm的窝洞

解析：复合树脂的填充技术有整块填充和分层填充技术。整块填充采用特殊的复合树脂，一次填充的厚度不超过4mm。掌握“牙体充填材料之复合树脂”知识点。